关于药品有效期的说法，正确的是
A. 有效期可用加速试验预测，用长期试验确定
B. 根据化学动力学原理，用高温试验按照药物降解1%所需的时间计算确定有效期
C. 有效期按照药物降解50%所需时间进行推算
D. 有效期按照t₀.₁=0.1054/k公式进行推算；用影响因素试验确定
E. 有效期按照t₀.₉=0.693/k公式进行推算，用影响因素试验确定

正确答案：A。有效期可用加速试验预测，用长期试验确定

解析：本题考查药品有效期。关于药品有效期的说法，正确的是有效期可用加速试验预测，用长期试验确定（A对）。药品有效期是指药品被批准使用的期限，表示该药品在规定的贮存条件下能够保证质量的期限，它是控制药品质量的指标之一，一般用加速试验预测，用长期试验确定。对于药物降解，通常用降解10%（BC错）所需的时间定义为有效期。恒温时，t₀.₉=0.1054/k（DE错）。